以社区人群和家庭为基础提供的医疗保健服务，超越了传统意义上的医疗服务，融入许多社会服务措施，因此被称为
A. 社区医疗服务
B. 社区保健服务
C. 社区健康服务
D. 社区卫生服务
E. 社区口腔卫生服务

正确答案：D。社区卫生服务

解析：以社区人群和家庭为基础提供的医疗保健服务，通常会超越传统意义上的医疗服务范畴，融入许多社会服务措施，因此被称为社区卫生服务。掌握“社区口腔卫生服务”知识点。